脂溶性大，易进入中枢，起效快，半衰期短，按第一类精神药品管理的镇静药为
A. 艾司唑仑
B. 奥沙西泮
C. 扎来普隆
D. 奥沙唑仑
E. 三唑仑

正确答案：E。三唑仑

解析：本题考查苯二氮䓬类药物。脂溶性大，易进入中枢，起效快，半衰期短，按第一类精神药品管理的镇静药为三唑仑（E对）。三唑仑结构中1，4-苯二氮䓬的1，2位并入了三唑环，脂溶性增加，代谢稳定性增加，提高了药物与受体的亲和力，镇静催眠和抗焦虑作用明显增强，按一类精神药品进行管理。艾司唑仑（A错）临床上用于：①治疗各种类型的失眠，催眠作用强，口服后20～60分钟可入睡，维持5小时。②治疗焦虑、紧张、恐惧及癫痫大、小发作，亦可用于术前镇静，被列为第二类精神药品管控。奥沙西泮（B错）是苯二氮䓬类药物地西泮3位引入羟基所得，被列为第二类精神药品管控。扎来普隆（C错）为镇静催眠药，临床上主要用于失眠的短时间的治疗，可以使失眠病人很快入睡，缩短入睡时间，延长睡眠时间，减少觉醒的次数，被列为第二类精神药品管控。奥沙唑仑（D错）是一种有机化合物，临床上主要用于治疗精神病、神经官能症、癫痫和各种疾病所引起的紧张、不安、抑郁、疲劳等情绪障碍，以及自主神经症状及失眠，被列为第二类精神药品管控。